在下列药物中，治疗黄疸应首选
A. 大黄
B. 郁金
C. 茵陈蒿
D. 虎杖
E. 栀子

正确答案：C。茵陈蒿

解析：茵陈蒿苦泄下降，微寒清热，善于清利脾胃肝胆湿热，使之从小便而出，为治黄疸之要药（C对）。大黄（A错）有较强的泻下作用，能荡涤肠胃，为治疗积滞便秘的要药。郁金（B错）既能活血祛瘀以止痛，又能疏肝行气以解郁，善治气滞血瘀之证。虎杖（D错）功效是利湿退黄，清热解毒，散瘀止痛，止咳化痰；有清热利湿之效，可治湿热黄疸。栀子（E错）能清泻三焦火邪，泻心火而除烦，为治热病心烦、躁扰不宁的要药。